尘肺的X线胸片表现中，不规则形小阴影的病理基础是
A. 成熟的矽结节
B. 不太成熟的矽结节
C. 大块纤维化
D. 肺间质纤维化
E. 矽结节和大块纤维化

正确答案：D。肺间质纤维化